竞争性阻止肌苷酸转变为腺嘌呤核苷酸和鸟嘌呤核苷酸的药物是
A. 氟尿嘧啶
B. 阿糖胞苷
C. 羟基脲
D. 甲氨蝶呤
E. 巯嘌呤

正确答案：E。巯嘌呤

解析：本题考查干扰核酸生物合成的药物。竞争性阻止肌苷酸转变为腺嘌呤核苷酸和鸟嘌呤核苷酸的药物是巯嘌呤（E对）。巯嘌呤在体内受肌酐焦磷酸酶催化变成6-巯基嘌呤核苷酸（TIMP）后才有活性。TIMP可抑制肌苷酸转变腺苷酸和鸟苷酸，干扰嘌呤代谢，阻碍DNA的合成。氟尿嘧啶（A错）为胸苷酸合成酶抑制剂。阿糖胞苷（B错）为DNA多聚酶抑制剂。羟基脲（C错）为核苷酸还原酶抑制剂。甲氨蝶呤（D错）为二氢叶酸还原酶抑制剂。